显微观察时能使茯苓团块溶解，并显橙红色至深红色的试液是
A. 蒸馏水
B. 水合氯醛试液
C. 甘油醋酸试液
D. 稀盐酸
E. α-萘酚试液及硫酸

正确答案：E。α-萘酚试液及硫酸